对肠结核最有诊断价值的检查是
A. X线钡餐检查发现肠腔狭窄
B. 结肠镜检查示回盲部炎症
C. 结肠镜下活检找到干酪性上皮样肉芽肿
D. 结核菌素试验强阳性
E. 大便中查到结核杆菌

正确答案：C。结肠镜下活检找到干酪性上皮样肉芽肿

解析：结肠镜下活检，发现肉芽肿、干酪坏死对肠结核具有诊断意义（C对）。肠腔狭窄（A错）可见于克罗恩病（P377）、结肠癌（P381）等多种肠道疾病，不具特异性。回盲部炎症（B错）对诊断肠结核无意义。结核菌素试验强阳性（D错）仅说明患者有结核分枝杆菌感染。大便中查到结核杆菌（E错）仅表明肠道内含有结核杆菌，可能由肺结核患者吞咽下结核杆菌引起。